男性，36岁，已婚，因龟头部赘生物1周就诊，在其龟头及冠状沟部可见数个乳头瘤样小丘疹，表面潮湿柔软，呈污灰色，承认不洁性接触史，醋酸白试验阳性，其最可能的诊断为
A. 尖锐湿疣
B. 扁平湿疣
C. 假性湿疣
D. 生殖器鲍温样丘疹病
E. 阴茎珍珠状丘疹病

正确答案：A。尖锐湿疣

解析：本题考查尖锐湿疣。尖锐湿疣是由人乳头瘤病毒（HPV）感染所致的以肛门生殖器部位增生性损害为主要表现的性传播疾病。大多发生于18～50岁的中青年人。大约经过半个月至8个月，平均为3个月的潜伏期后发病。此病较为常见，主要通过性接触传播。题干说明有不洁性接触史，其最可能的诊断为尖锐湿疣（A对BCDE错）。